患者，女，65岁。心悸胸闷水肿十余年，近日病情加重，全身冷汗淋漓，神志时清时昏，面色苍白，手足冰凉，舌质淡胖，脉细微无力，应急用人参配伍的药物是
A. 白术
B. 党参
C. 附子
D. 黄芪
E. 甘草

正确答案：C。附子

解析：人参甘温补虚，能大补元气，复脉固脱，为拯危救脱之要药。若气虚欲脱兼见汗出，四肢逆冷等亡阳征象者，常与回阳救逆的附子同用（C对），以补气固脱，回阳救逆，如参附汤。党参味甘性平，主归脾、肺二经，有与人参类似的补益脾肺之气作用而药力较弱，为补中益气之良药（B错）。人参归脾经，为补脾气之要药，凡脾气虚弱，倦怠乏力，食少便溏者，常与白术、茯苓、甘草配伍，如四君子汤（《和剂局方》）（AE错）。若脾气虚弱，不能统血异致失血者，本品又能补气以摄血，常与黄芪、白术等益气健脾药同用，如归脾汤（《济生方》）（D错）。